白血病时牙龈肿大是由于
A. 牙龈纤维结缔组织增生
B. 牙龈上皮增生
C. 成纤维细胞增生
D. 淋巴细胞大量浸润
E. 不成熟、无功能的白细胞大量浸润聚集

正确答案：E。不成熟、无功能的白细胞大量浸润聚集

解析：本题考查白血病的牙龈病损的病因。白血病是一种恶性血液疾病，大量增殖的不成熟血细胞充斥骨髓腔并取代了正常的骨髓细胞。血液中成熟血细胞的数量和形态异常，并可浸润至身体的各器官和组织，包括牙龈。牙龈肿大是由于不成熟、无功能的白细胞大量浸润聚集（E对）。牙龈纤维结缔组织增生（A错）、牙龈上皮增生（B错）、成纤维细胞增生（C错）、淋巴细胞大量浸润（D错）是牙周病患者牙龈肿大的原因。